关于先天性无牙症的描述错误的是
A. 多为显性遗传
B. 为遗传性疾病
C. 可累及恒牙和乳牙
D. 常常是外胚叶发育不全的一种表现
E. 口内仅有寥寥无几的牙齿或根本无牙

正确答案：A。多为显性遗传

解析：本题考查先天性无牙症。先天性无牙症是先天完全无牙或大多数牙齿先天缺失，常是外胚叶发育不全的一种表现（D对）。该病是常染色体隐性遗传（B对）（A错，为本题的正确答案）。口腔中最突出的表现是先天缺牙，乳牙和恒牙常常全部缺失（C对），或仅有寥寥无几的牙齿或根本无牙（E对）。